下列关于抗抑郁药的合理应用与药学监护的说法，错误的是
A. 抗抑郁药起效较快，使用1周后可判定疗效
B. 应尽可能单一用药，足量、足疗程治疗
C. 剂量递增，尽可能采用最小有效剂量，使不良反应减至最小
D. 当单药治疗无效时，可考處联合使用两种作用机制不同的抗抑郁药
E. SSRIs类抗抑郁药不宜与单胺氧化酶抑制剂联合使用

正确答案：A。抗抑郁药起效较快，使用1周后可判定疗效

解析：本题考查抗抑郁药的应用。抗抑郁药多数需要至少2周才会有显著的情绪反应，12周后才会有完整的治疗效果（A错，为本题正确答案）。抗抑郁药在使用中尽量单一用药，应足量、足疗程治疗（B对），一般不主张联用两种以上抗抑郁药（D对）。抗抑郁药尽可能采用最小有效剂量，使不良反应减至最小（C对）。各种抗抑郁药物均不可与单胺氧化酶抑制剂（MAOIs）联合使用（E对）。